下列各项，不属普通型流脑典型表现的是
A. 头痛
B. 呕吐
C. 抽搐
D. 出血点
E. 病理征阳性

正确答案：C。抽搐

解析：普通型流脑典型表现是突发高热、剧烈头痛（A对）、频繁呕吐（B对），皮肤黏膜瘀点、瘀斑（D对）及脑膜刺激征（E对），严重者可有败血症休克和脑实质损害，常可危及生命（C错，为本题正确答案）。